一般不宜用糖皮质激素类药物治疗的病症是
A. 败血症
B. 中毒性肺炎
C. 重症伤寒
D. 腮腺炎
E. 中毒性菌痢

正确答案：D。腮腺炎